妊娠恶阻脾胃虚弱证的特点是
A. 呕吐痰涎
B. 干呕
C. 呕吐黏痰
D. 呕吐酸水或苦水
E. 呕吐血性分泌物

正确答案：A。呕吐痰涎

解析：妊娠期间，脾胃素虚，升降失常，孕后阴血下聚养胎，冲气上逆犯胃，胃失和降，故恶心呕吐不食，甚则食入即吐；脾胃虚弱，运化失司，水湿内停随胃气上行，或聚湿成痰，故口淡，呕吐清涎或痰涎，脘痞腹胀，作为最佳选项应该(A对)。口吐黏痰：体内热毒蕴结，灼伤津液形成黏痰（C错）。呕吐酸水或苦水多属肝胆郁热或湿热（D错）。呕吐血性分泌物，夹有食物残渣者，属胃有积热，或肝火犯胃，或胃府血瘀所致（E错）。干呕多由胃失和降，气逆上冲引起的（B错）。